静脉角是下述哪两条静脉的夹角
A. 左、右头臂静脉
B. 上、下腔静脉
C. 颈内、外静脉
D. 锁骨下静脉、颈内静脉
E. 颈外静脉、锁骨下静脉

正确答案：D。锁骨下静脉、颈内静脉

解析：锁骨下静脉、颈内静脉（D对）两条静脉之间的汇合部称静脉角，是淋巴导管的注入部位。